链激酶可用于治疗血栓性疾病，是由于
A. 扩张血管
B. 抑制凝血因子
C. 抑制血小板聚集
D. 促进纤溶酶原合成
E. 激活纤溶酶原

正确答案：E。激活纤溶酶原

解析：链激酶属于纤维蛋白溶解药，可以激活纤溶酶原（E对），使纤维蛋白溶酶原转变为纤维蛋白溶酶，纤溶酶可以降解纤维蛋白和纤维蛋白原而限制血栓增大和溶解血栓，治疗血栓性疾病。抑制凝血因子（B错）是抗凝血酶药如肝素、香豆素类药物的抗凝血机制。抑制血小板聚集（C错）是增加血小板内c-AMP的药物如双嘧达膜、依前列醇等的抗凝血机制。扩张血管（A错）、促进纤溶酶原合成（D错）并非目前常用药物治疗血栓性疾病的机制。